铊在人体内分布浓度最高的脏器是
A. 肝脏
B. 心脏
C. 脾脏
D. 肾脏
E. 胃肠

正确答案：D。肾脏

解析：本题考查铊在人体内分布浓度最高的脏器。铊对人体健康的危害主要是由于植物富集或者附着在烟尘上通过消化道、呼吸道、皮肤进入人体，随着血液分布于全身组织所致。铊在人体内分布浓度以肾脏（D对ABCE错）中含量最高，其次是肌肉、骨骼、肝脏、心脏、胃、肠、脾、神经组织、睾丸，皮肤和毛发中也有一定量铊。